吗啡的临床应用是
A. 颅脑损伤
B. 分娩止痛
C. 支气管哮喘
D. 休克
E. 血压正常的心肌梗死剧痛

正确答案：E。血压正常的心肌梗死剧痛

解析：吗啡的临床应用为1.疼痛：对心肌梗死的剧痛，血压正常者可用吗啡（E对），除镇痛外，可减轻患者的焦虑和心脏负担2.心源性哮喘3.腹泻4.咳嗽。